属于酮体的是
A. α-酮戊二酸
B. 乙酰乙酸
C. 肌醇
D. 胆汁酸
E. 琥珀酰CoA

正确答案：B。乙酰乙酸

解析：酮体包括乙酰乙酸（B对）、β-羟丁酸和丙酮。